风险交流的原则不包括
A. 责任分担
B. 保证透明度
C. 正确对待风险
D. 信息来源的广泛性
E. 应培育交流的技能

正确答案：D。信息来源的广泛性

解析：本题考查风险交流的原则。风险交流的原则包括：①要了解听众；②应把科学家包括在内；③应培育交流的技能（E对）；④信息来源的可靠；⑤责任分担（A对）；⑥区分科学和价值观；⑦保证透明度（B对）；⑧正确对待风险（C对）。信息来源的广泛性（D错，为本题正确答案）不属于风险交流的原则。